收纳乳房外侧部的淋巴
A. 胸骨旁淋巴结
B. 胸肌淋巴结
C. 肩胛下淋巴结
D. 外侧淋巴结
E. 尖淋巴结

正确答案：B。胸肌淋巴结

解析：乳房外侧部和中央部淋巴管注入胸肌淋巴结（B对）。乳房上部淋巴管注入尖淋巴结和锁骨上淋巴结（E错）。乳房内侧部淋巴管注入胸骨旁淋巴结（A错）。